男孩，1岁。发热8天，皮疹3天入院。外院抗生素治疗7天无效。查体：T39℃，烦躁不安，全身淡红色斑丘疹，双眼结膜充血，口唇鲜红、干裂、草莓舌，右颈淋巴结蚕豆大，质硬，有压痛。双肺呼吸音粗，心率130次/分，腹软，肝、脾无肿大，指、趾端硬性肿胀。实验室检查：血WBC19×10⁹/L，N0.78，L0.22，Plt420×10⁹/L，血沉120mm/h，血培养（-）。首选的治疗措施是
A. 丙种球蛋白+糖皮质激素
B. 对症治疗，观察
C. 丙种球蛋白+阿司匹林
D. 阿司匹林+糖皮质激素
E. 青霉素

正确答案：C。丙种球蛋白+阿司匹林

解析：患儿，发热8天，有皮疹、眼结膜充血、草莓舌、颈淋巴结肿大、指和趾端硬性肿胀的临床表现，符合川崎病的临床表现，应诊断为川崎病。虽然单独使用丙种球蛋白也可以治疗川崎病，但丙种球蛋白+阿司匹林可预防冠状动脉病变的发生，所以川崎病急性期的最佳治疗药物是丙种球蛋白+阿司匹林（C对）。糖皮质激素可促进血栓的形成，加重冠状动脉病变（AD错）。该患儿已经有了严重的临床表现，应积极治疗，不应对症治疗，观察（B错）。川崎病是免疫病，对青霉素不敏感（E错）。